肺下界在腋中线相交于
A. 第5肋
B. 第6肋
C. 第7肋
D. 第8肋
E. 第10肋

正确答案：D。第8肋

解析：肺下界在腋中线相交于第8肋（D对）。